患者因缺失牙修复时发现邻牙楔状缺损，要求治疗。查：右上67缺失，右上5颊面楔状缺损，中等深，充填时最好选用
A. 玻璃离子水门汀
B. 银汞合金
C. 磷酸锌水门汀
D. 羧酸锌水门汀
E. 以上均可以

正确答案：B。银汞合金

解析：本题考查银汞合金充填术的适应证。患者因缺失牙修复时发现邻牙楔状缺损，要求治疗。查：右上67缺失，右上5颊面楔状缺损，中等深，充填时最好选用银汞合金（B对）。根据病例描述，患者右上67缺失行修复治疗时，发现右上5颊面楔状缺损，中等深，要求治疗，可知患者右上5会作为右上67可摘义齿修复的基牙，其颊侧颈部（楔状缺损处）会放置卡环，故右上5的楔缺缺损选用银汞合金充填最佳。玻璃离子水门汀（A错）虽然美观性佳，但其强度较银汞合金低很多，不耐磨，不适宜病例中右上5的楔状缺损充填。磷酸锌水门汀（C错）和羧酸锌水门汀（D错）强度都比玻璃离子低，美观性也欠佳，并且多用于暂时性修复，不作永久充填。